男性，21岁。近半年来反复、心悸、胸痛、劳力性呼吸困难。时有头晕或短暂神志丧失。体检发现：心脏轻度增大，心尖部有2级收缩期杂音和第四心音，胸骨左缘第3～4肋间闻及较粗糙的喷射性收缩期杂音。最可能的诊断是
A. 冠心病心绞痛
B. 二尖瓣关闭不全
C. 主动脉瓣狭窄
D. 肥厚型梗阻性心肌病
E. 病毒性心肌炎

正确答案：D。肥厚型梗阻性心肌病

解析：患者青年男性，反复心悸、胸痛、劳力性呼吸困难，时有头晕或短暂神志丧失，体检发现：心脏轻度增大，心尖部有2级收缩期杂音和第四心音，胸骨左缘第3～4肋间闻及较粗糙的喷射性收缩期杂音（提示流出道梗阻），综合患者的病史、临床表现和体查，最可能的诊断是肥厚型梗阻性心肌病（D对）。冠心病心绞痛（A错）典型表现为与劳力有关的心绞痛，休息后可缓解，不会出现胸骨左缘第3～4肋间的杂音。二尖瓣关闭不全（P292）（B错）的典型杂音为心尖区全收缩期吹风样杂音，杂音强度多≥3/6级，一般也不会出现胸骨左缘第3～4肋间的杂音。主动脉瓣狭窄（P296）（C错）多可于胸骨右缘1～2肋间闻及粗糙而响亮的射流性杂音。病毒性心肌炎（P270）（E错）患者发病前多有病毒感染前驱症状，如发热、全身倦怠感和肌肉酸痛等。